某女，42岁。因月经不调就诊，诊断为月经后期，辨证属气滞血瘀证，宜选用的中成药是
A. 乌鸡白凤丸
B. 丹栀逍遥丸
C. 益母丸
D. 妇科调经片
E. 艾附暖宫丸

正确答案：C。益母丸

解析：本题考查的是月经后期的辨证论治。因月经不调就诊，诊断为月经后期，辨证属气滞血瘀证，宜选用的中成药是益母丸（C对）。月经后期：月经周期延后7天以上，甚至3～5个月一行者，称为“月经后期”。既往亦有称“经行后期”“月经延后”“月经错后”“经迟”等。一般认为要连续出现两个周期以上，若每次仅延后三五天，或偶然延后一次，下次仍如期来潮者，均不作月经后期论。此外，如在月经初潮后1年内，或月经将绝之时，周期时有延后，且无其他症状者，亦不作病论。西医学的月经稀发表现为上述症状者，可参考此内容辨证论治。（一）肾虚证：【中成药应用】常用中成药有春血安胶囊、天紫红女金胶囊。（二）血虚证：【中成药应用】常用中成药有复方益母草膏、四物益母丸。（三）气滞证：【中成药应用】常用中成药有益母丸、得生丸、调经丸、调经活血片。（四）痰湿证：【中成药应用】常用中成药有二陈丸。乌鸡白凤丸（A错）为崩漏气血两虚证的中成药应用。崩漏气血两虚证：【中成药应用】常用中成药有定坤丹、乌鸡白凤丸、养血饮口服液。丹栀逍遥丸（B错）为月经先期肝郁血热证的中成药应用。月经先期肝郁血热证：【中成药应用】常用中成药有丹栀逍遥丸。妇科调经片（D错）为月经先后无定期肝郁证的中成药应用。月经先后无定期肝郁证：【中成药应用】常用中成药有妇科调经片、香附丸、妇科十味片。艾附暖宫丸（E错）：【功能】理气养血，暖宫调经。【主治】血虚气滞、下焦虚寒所致的月经不调、痛经，症见行经后错、经量少、有血块、小腹疼痛、经行小腹冷痛喜热、腰膝酸痛。